按照我国相关规定，标注为“加工原料为转基因××”的产品是
A. 转基因植物产品
B. 转基因微生物产品
C. 含有转基因微生物成分的农药
D. 含有转基因微生物成分的种子
E. 转基因植物的直接加工品

正确答案：E。转基因植物的直接加工品

解析：本题考查国家对农业转基因生物实行的标识制度。按照我国相关规定，标注为“加工原料为转基因××”的产品是转基因农产品的直接加工品（E对ABCD错）。